小儿鹅口疮口腔局部的临床特征是
A. 口腔黏膜出现单个或成簇的小疱疹
B. 口腔黏膜充血、水肿，可有疱疹
C. 口腔创面有纤维素渗出物形成或灰白色假膜，易拭去
D. 口腔黏膜表面覆盖有白色乳凝块样片状物，不易拭去
E. 口腔黏膜出现大小不等的糜烂或溃疡

正确答案：D。口腔黏膜表面覆盖有白色乳凝块样片状物，不易拭去

解析：鹅口疮是常见的一种口腔疾病，因患儿口腔及舌上生有白屑或白膜满布，状如鹅口而得名，主要为口腔黏膜上出现白色或灰白色乳凝块样白膜，初起时，呈点状和小片状，微凸起，可逐渐融合成大片，白膜界线清楚，不易拭去，如强行剥落后，可见充血、糜烂创面，局部黏膜潮红粗糙，可有溢血，但不久又为新生白膜覆盖（D对）。口腔黏膜出现单个或成簇的小疱疹（A错）见于疱疹性口炎。口腔黏膜充血、水肿，可有疱疹（B错）和口腔创面有纤维素渗出物形成或灰白色假膜，易拭去（C错）见于细菌感染性口炎口腔局部的临床特征。口腔黏膜出现大小不等的糜烂或溃疡（E错）可见于口糜。